流量大的江河，污水在断面可出现
A. 岸边污染带
B. 污染物在断面分布均匀并多方位扩散
C. 水华
D. 赤潮
E. 海水入侵

正确答案：A。岸边污染带

解析：本题考查河流的污染特点。河流的污染程度取决于河流的径污比（径流量与排入河流中污水量的比值），河流的径污比大，稀释能力强，河流受污染的可能性和污染程度较小。流量大的江河，污水不易在全断面混合，只在岸边形成浓度较高的污染带（A对BCDE错），影响下游局部水域的水质。